根据《药品经营许可证管理办法》，监督检查的内容包括
A. 检查药品专利实施情况
B. 检查GSP的实施情况
C. 检查仓库的情况
D. 检查经营方式
E. 检查企业内部劳动保障情况

正确答案：B、C、D。检查GSP的实施情况；检查仓库的情况；检查经营方式

解析：本题考察药品监督管理。监督检查的内容包括：（1）企业名称、经营地址、仓库地址（C对）、企业法定代表人(企业负责人)、质量负责人、经营方式（D对）、经营范围、分支机构等重要事项的执行和变动情况。（2）企业经营设施设备及仓储条件变动情况。(3)企业实施《药品经营质量管理规范》情况（B对）。